男，30岁。右下6金属全冠粘固1周后脱落，咬合时常有瞬间性疼痛。口腔检查见患者咬合紧，牙冠短，对颌牙面有银汞合金充填物，脱落的全冠完整。全冠脱落最可能的原因是
A. 牙体预备聚合度过大
B. 修复体不密合
C. 力过大
D. 粘固面积过小
E. 修复体粘接面未清洁干净

正确答案：D。粘固面积过小

解析：本题考查全冠脱落的原因。全冠获得固位的主要固位力有约束力、摩擦力和粘接力，其中粘接力与粘着面积成正比，在同样情况下，粘接面积越大，粘接力越强。口腔检查发现患者咬合紧，牙冠短。在同样情况下，牙冠越短，（牙合）龈距过小，粘接面积越小，粘接力就越小，修复体获得固位力小，牙冠易脱落，因此黏固面积过小（D对）是导致全冠脱落的原因。牙体预备聚合度过大（A错），全冠受外力时对侧牙体组织无阻挡，致使牙冠脱位，与题干无关；修复体不密合（B错），修复体与牙冠之间摩擦力变小，故固位力小，全冠容易脱落，题干未提及；力过大（C错）、（牙合）力集中，侧向力过大，导致牙冠易脱位，但此因素与本题干并不相符；修复体粘接面未清洁干净（E错）影响粘接剂的粘结效果，粘接力变小，固位力变小，与题干无关。